女，21岁。因工作紧张，近一个月感觉压力重重，不能胜任工作，觉的自己一无是处，连累了父母，开煤气自杀被急送入院。入院后又趁人不备打破窗玻璃，用碎玻璃自杀，后经抢救脱险。经检查患者有青光眼病史。最可能诊断是
A. 应激障碍
B. 抑郁症
C. 虚无心境
D. 坏性心境障碍
E. 焦虑症

正确答案：B。抑郁症

解析：该病患近一个月（病程持续时间大于2周）觉得自己一无是处（自我评价低，无价值感），连累了父母（自罪观念），开煤气自杀，入院后又趁人不备用碎玻璃自杀（自杀观念和行为），最可能的诊断为抑郁症（B对）。焦虑症以焦虑为主要临床表现，患者常常有不明原因的提心吊胆、紧张不安，无情感低落（忧愁、苦闷、唉声叹气、暗自落泪，严重时可因悲观绝望而出现自杀企图及行为等）的典型症状，与本例不符（E错）。